患者，男，7岁。右下后牙菜花样溃疡2个月，溃疡约2.8cm×3cm大小，临近溃疡的牙齿略松动，右颈上部触及一淋巴结，约1.5cm×2.0cm大小，质偏硬、尚可活动，未发现远处转移。为了明确诊断，最佳的检查方法是
A. 切除活检
B. 切取活检
C. 吸取活检
D. 脱落细胞涂片
E. 细针穿刺细胞学活检

正确答案：B。切取活检

解析：活组织检查是指在病变部位取一小块组织制成切片，在显微镜下观察细胞组织形态，确定病变分期，是最为准确可靠的方法。切除活检在确诊之前不能确定切除范围，造成早期手术创口过大，增加感染和扩散风险。吸取活检同于细针穿刺细胞学活检，适用于涎腺和某些深部肿瘤的诊断。掌握“鳞状细胞癌概述及舌癌、牙龈癌”知识点。